TA98检测
A. 碱基置换突变
B. 大段损伤
C. DNA交联
D. 正向突变
E. 移码突变

正确答案：E。移码突变

解析：本题考查TA98检测的内容。Ames试验中TA98菌株用于检测移码突变（E对ABCD错）。